通过影响机体转运而产生药理作用的药物是
A. 利多卡因
B. 呋塞米
C. 卡托普利
D. 地西泮
E. 普萘洛尔

正确答案：A。利多卡因

解析：本题考查影响机体转运而产生药理作用的药物。通过影响机体转运而产生药理作用的药物是利多卡因（A对）。利多卡因抑制Na⁺通道，影响机体转运。